患儿，女，6岁，白天小便频而量少，夜晚睡中遗尿，面白，气短，大便溏，舌淡苔白，脉细针灸治疗本病，应加取
A. 百会、神门
B. 气海、血海
C. 阳陵泉、行间
D. 脾俞、肾俞、足三里
E. 气海、肺俞、足三里

正确答案：E。气海、肺俞、足三里

解析：疲劳后遗尿加重，少气懒言，食欲不振，大便溏薄，自汗出，舌淡，苔薄，脉细无力，为遗尿脾肺气虚证，治疗应加取气海、肺俞、足三里以补肺健脾（E对）。遗尿若夜梦多配百会、神门（A错）。月经不调主穴血海，若气虚配气海（B错）。遗尿若肝胆有热配阳陵泉、行间（C错）。遗尿若脾肾不足配脾俞、肾俞、足三里（D错）。